中国病毒性感染性腹泻暴发的最重要病原体是
A. 诺如病毒
B. 成人轮状病毒
C. A组轮状病毒
D. 肠腺病毒
E. 冠状病毒

正确答案：A。诺如病毒

解析：本题考查诺如病毒。中国病毒性感染性腹泻暴发的最重要病原体是诺如病毒（A对BCDE错）。诺如病毒感染性腹泻在全世界范围内均有流行，全年均可发生感染，感染对象主要是成人和学龄儿童，寒冷季节呈现高发。